既能祛风湿，又能退虚热的药物是
A. 独活
B. 秦艽
C. 防己
D. 狗脊
E. 川乌

正确答案：B。秦艽

解析：该题考查的是秦艽的功效，属记忆内容。秦艽的功效 祛风湿，通络止痛，退虚热，清湿热（B对）。